心律失常患者首选的局部麻醉药是
A. 普鲁卡因
B. 利多卡因
C. 地卡因
D. 可卡因
E. 氯乙烷

正确答案：B。利多卡因

解析：利多卡因还有迅速、安全的抗室性心律失常作用，在治疗各种原因的窒性心律失常时效果显著，因而对心律失常患者常作为首选的局部麻醉药。本品毒性较普鲁卡因大，用作局麻时，一次最大用量为300～400mg，使用时应分次小量注射。掌握“颌面部常用局部麻醉药物”知识点。